医疗事故的鉴定应由
A. 医师学会负责
B. 医学会负责
C. 医疗事故技术鉴定专家组负责
D. 卫生行政部门负责
E. 法院负责

正确答案：B。医学会负责

解析：本题考查医疗事故的技术鉴定。鉴定组织及其分工：医学会负责（B对）组织医疗事故技术鉴定。具体的鉴定工作由医患双方随机抽取的专家鉴定组作出。首次医疗事故技术鉴定工作，由设区的市级地方医学会和省、自治区、直辖市直接管辖的县（市）地方医学会负责组织。再次医疗事故技术鉴定工作，由省、自治区、直辖市地方医学会负责组织。